强心苷对心肌电生理的影响包括
A. 降低窦房结和心房自律性
B. 降低浦氏纤维自律性
C. 减慢房室传导
D. 缩短心房有效不应期
E. 缩短心室肌有效不应期

正确答案：A、C、D、E。降低窦房结和心房自律性；减慢房室传导；缩短心房有效不应期；缩短心室肌有效不应期